阿司匹林可以用三氯化铁鉴别的原理是
A. 三氯化铁被还原而显色
B. 阿司匹林被氧化而显色
C. 阿司匹林与三价铁配位而显色
D. 阿司匹林水解产物水杨酸与三价铁配位而显色
E. 阿司匹林水解产物水杨酸被氧化而显色

正确答案：D。阿司匹林水解产物水杨酸与三价铁配位而显色

解析：本题考查常用的药品鉴别方法。阿司匹林为水杨酸酯类药物，加热水解后产生水杨酸，水杨酸及其盐在中性或弱酸性（pH值4～6）条件下，会与三氯化铁试液反应，生成紫堇色配位化合物（D对）。